促进健康的行为具有下列特征
A. 有利性
B. 有利性、规律性
C. 有利性、规律性、和谐性
D. 有利性、规律性、和谐性、一致性
E. 有利性、规律性、和谐性、一致性、适宜性

正确答案：E。有利性、规律性、和谐性、一致性、适宜性